天南星的药用部位是
A. 根
B. 根茎
C. 块茎
D. 根及根茎
E. 鳞茎

正确答案：C。块茎

解析：本题考查的是天南星的来源。天南星的药用部位是块茎（C对）。天南星：【来源】为天南星科植物天南星、异叶天南星或东北天南星的干燥块茎。入药部位为根（A错）的中药有牛膝、川牛膝、商陆、银柴胡、白芍、赤芍、板蓝根、地榆、苦参、葛根、粉葛、黄芪、西洋参、白芷、当归等。入药部位为根茎（B错）的中药有狗脊、黄连、升麻、北豆根、川芎、胡黄连、白术、苍术、香附、石菖蒲、黄精、玉竹、重楼、土茯苓、知母、射干、莪术、姜黄等。入药部位为根及根茎（D错）的中药有大黄、山豆根、甘草、三七、龙胆、紫菀、细辛、威灵仙、人参、红参、徐长卿、白薇、丹参、茜草等。入药部位为鳞茎（E错）的中药有川贝母、浙贝母等。